从左到右反流的先天性心脏病出现艾森曼格综合征，出现的症状为
A. 乏力，出汗
B. 持续性青紫
C. 发育生长迟缓
D. 心尖上翘
E. 体重下降

正确答案：B。持续性青紫

解析：从左到右反流的先天性心脏病出现艾森曼格综合征，可出现持续性青紫的症状，其余不属于艾森曼格综合征的表现（B对）。